IgG通过胎盘主要决定于哪一部位
A. Fab段
B. CH2区
C. F（ab）2'
D. Fc段
E. 绞链区

正确答案：D。Fc段